原始骨痂形成需要
A. 1周左右
B. 2～3周
C. 4～8周
D. 9～10周
E. 12周~24周

正确答案：E。12周~24周

解析：骨折愈合过程包括血肿炎症机化期、原始骨痂形成期和骨痂改造塑形期。根据九版外科学P618，骨折愈合过程中血肿机化演进期一般约需2周，原始骨痂形成期一般约需3~6个月，骨痂改造塑形期约需1～2年，本题无正确选项。七版外科学数据为血肿机化期大约2周，原始骨痂形成期大约4～8周，骨痂改造塑性期约为8～12周。本题为老知识点，现在应以新版教材为主。